下列关于甘露醇的叙述不正确的是
A. 静脉注射后，能迅速提高血浆渗透压
B. 体内不被代谢
C. 口服用药则造成渗透性腹泻，可用于从胃肠道消除毒性物质
D. 治疗脑水肿、降低颅内压安全而有效的首选药物
E. 易被肾小管重吸收

正确答案：E。易被肾小管重吸收

解析：甘露醇药理作用①脱水作用：静脉注射后，能迅速提高血浆渗透压，使组织间液向血浆转移而产生组织脱水作用。口服用药则造成渗透性腹泻，可用于从胃肠道消除毒性物质。②利尿作用：静脉注射甘露醇后，通过稀释血液而增加循环血容量及肾小球滤过率。该药在肾小球滤过后不易被重吸收，使水在髓袢升支和近曲小管的重吸收减少，而产生利尿作用。甘露醇临床应用①甘露醇是治疗脑水肿、降低颅内压安全而有效的首选药物。也可用于青光眼急性发作和患者术前应用以降低眼内压。②可用于预防急性肾衰竭。在少尿时，通过脱水作用，可减轻肾间质水肿。同时渗透性利尿效应可维持足够的尿量，稀释肾小管内有害物质。对肾衰竭伴有低血压者效果较好。掌握“保钾利尿药和渗透性利尿药”知识点。